下列细胞因子中，与慢性阻塞性肺疾病慢性气道炎症发病关系最密切的是
A. IL-4
B. IL-10
C. IL-5
D. IL-8
E. IL-13

正确答案：D。IL-8

解析：许多研究表明慢阻肺患者的氧化应激增加。氧化物可直接作用并破坏许多生化大分子如蛋白质、脂质和核酸等，导致细胞功能障碍或细胞死亡，还可以破坏细胞外基质；引起蛋白酶-抗蛋白酶失衡；促进炎症反应，如激活转录因子NF-kB，参与多种炎症介质的转录，如IL-8（D对）、TNF-α以及诱导一氧化氮合酶（NOS）和环氧化物酶等的转录（P22）。